惊厥性全身性癫痫持续状态静脉注射苯妥英钠时，每1～2分钟注射速度最多不应大于
A. 10mg
B. 20mg
C. 50mg
D. 70mg
E. 100mg

正确答案：C。50mg

解析：惊厥性全身性癫痫持续状态是临床最常见、最危险的癫痫持续状态，应及时静脉用药治疗。静脉注射苯妥英钠时，每1-2分钟注射速度最多不应大于50mg（C对）。